下列不属于药物临床评价意义的是
A. 解决临床前研究的局限性
B. 扩展不同种属的动物毒性试验
C. 解决上市前临床研究的局限性
D. 扩展药物上市后的临床应用范围
E. 促进合理用药

正确答案：B。扩展不同种属的动物毒性试验